中国药典规定需要检查杂质“硒”的药物是
A. 肾上腺素
B. 阿司匹林
C. 对乙酰氨基酚
D. 吗啡
E. 醋酸地塞米松

正确答案：E。醋酸地塞米松

解析：本题考查硒的检查。有的甾体激素类药物如醋酸地塞米松（E对）、醋酸氟轻松、醋酸曲安奈德等在生产工艺中需要使用二氧化硒脱氢，在药物中可能引入杂质硒。硒对人体有毒害，所以需进行检查并严格控制其含量。